形成牙骨质的结构是
A. 成釉器
B. 牙乳头
C. 牙囊
D. 牙板
E. 前庭板

正确答案：C。牙囊

解析：牙胚由牙板及邻近的外胚间叶组织发育而来，牙板的发生是牙齿发育的开始。牙胚由成釉器、牙乳头和牙囊构成。牙胚将形成4种牙体组织和部分牙周组织，其中成釉器形成釉质，牙乳头形成牙本质和牙髓，牙囊形成牙骨质、牙周膜和部分牙槽骨。掌握“牙胚的发生及分化”知识点。